丹参中含有的丹参酮，其结构类型是
A. 醌类
B. 三萜类
C. 甾体类
D. 香豆素类
E. 黄酮类

正确答案：A。醌类

解析：本题考查的是丹参酮结构类型。丹参中含有的丹参酮，其结构类型是醌类（A对）。丹参中的化学成分主要分为两类：脂溶性的二萜醌类化合物和水溶性的酚酸类成分。二萜醌类化合物大部分为丹参酮型的二萜醌类化合物，包括邻醌型的丹参酮类二萜和对醌型的罗列酮类二萜及其他类型。酚酸类成分主要是丹参素、丹酚酸A、丹酚酸B、丹酚酸C、迷迭香酸、原儿茶酸、紫草酸单甲酯，其中丹酚酸B是丹参中酚性酸的主要成分。《中国药典》要求测定丹参中丹参酮类和丹酚酸B的含量。三萜类（B错）：多数三萜类化合物是一类基本母核由30个碳原子组成的萜类化合物，其结构根据异戊二烯定则可视为六个异戊二烯单位聚合而成，也是一类重要的中药化学成分。含三萜类化合物的中药有人参、三七、甘草、黄芪、合欢皮、商陆、柴胡等。甾体类（C错）：甾体类化合物是广泛存在于自然界中的一类天然化学成分，包括植物甾醇、胆汁酸、C₂₁甾类、昆虫变态激素、强心苷、甾体皂苷、甾体生物碱、蟾毒配基等。香豆素类（D错）：香豆素是邻羟基桂皮酸的内酯，广泛分布于高等植物中，尤其以芸香科和伞形科为多见，少数发现于动物和微生物中。在植物体内，它们往往以游离状态或与糖结合成苷的形式存在。黄酮类（E错）：黄酮类化合物广泛存在于自然界中，多存在于高等植物及羊齿类植物中。苔类中含有的黄酮类化合物为数不多，而藻类、霉菌、细菌中没有发现黄酮类化合物。含黄酮类化合物的中药有黄芩、葛根、银杏叶、槐花、陈皮、满山红等。